金银花中的抗菌有效成分是
A. 胆酸
B. 别胆酸
C. 牛磺酸
D. 粪甾烷酸
E. 绿原酸

正确答案：E。绿原酸